治疗指数窄，使用过程中应监测国际标准化比值（INR），并将其稳定控制在2.0～3.0的药品是
A. 华法林
B. 肝素
C. 依诺肝素
D. 氯吡格雷
E. 达比加群酯

正确答案：A。华法林

解析：本题考查华法林。华法林（A对）治疗指数窄，使用过程中应监测国际标准化比值（INR），并将其稳定控制在2.0～3.0之间。体重低于50kg患者、老年或肝功能不全患者，需降低剂量，使INR控制在较低的有效水平（1.8～2.5）。